不属于蔓状血管瘤临床表现的是
A. 体位移动试验阳性
B. 表面皮温高
C. 扪诊有震颤感
D. 听诊有吹风样杂音
E. 肿瘤高起呈念珠状

正确答案：A。体位移动试验阳性

解析：本题考查动静脉畸形的临床表现。蔓状血管瘤（动静脉畸形）是一种迂回弯曲、极不规则而有搏动性的血管畸形，主要是由血管壁显著扩张的动脉与静脉直接吻合而成，多见于成人，形态与体位无关。体位移动试验阳性可见于海绵状血管瘤（A错，为本题的正确答案）。蔓状血管瘤表面皮温高（B对），扪诊有震颤感（C对），听诊有吹风样杂音（D对），病损高起呈念珠状（E对）。